风热咳嗽的治疗首选方是
A. 银翘散
B. 杏苏散
C. 桑菊饮
D. 金沸草散
E. 清金化痰汤

正确答案：C。桑菊饮

解析：该题考查治疗风热咳嗽的方药以及对以下方药的鉴别。风热咳嗽中，若风热夹湿者，咳嗽痰多，胸闷汗出，舌苔黄腻，脉濡数，治疗首选方桑菊饮加减（C对）。银翘散辛凉透表，清热解毒，治疗温病初起（A错）。杏苏散轻宣凉燥，理肺化痰，主治外感凉燥证（B错）。金沸草散治疗风寒咳嗽（D错）。清金化痰汤治疗内伤咳嗽之痰热咳嗽（E错）。